的吸收峰的波数
A. 3500～3300cm⁻¹
B. 3500cm⁻¹
C. 1695cm⁻¹
D. 1615cm⁻¹
E. 870cm⁻¹

正确答案：D。1615cm⁻¹

解析：本题考查红外吸收光谱。4位烯双键的νC=O吸收峰归属基团是C=C，故峰位在1670～1500cm⁻¹ （D对）。3750～3000cm⁻¹（AB错）归属O-H或N-H。1695cm⁻¹（C错）归属基团νC=0。870cm⁻¹（E错）是不同取代形式双键、苯环的特殊吸收峰。